关于急性胰腺炎，下列说法正确的是
A. 血清淀粉酶在发病3～6小时后开始升高
B. 血清淀粉酶在8小时达峰值
C. 血清淀粉酶超正常值2倍可诊断急性胰腺炎
D. 淀粉酶的高低并不一定反映病情的严重程度
E. 尿淀粉酶升高持续时间比血清淀粉酶短

正确答案：D。淀粉酶的高低并不一定反映病情的严重程度

解析：淀粉酶值愈高诊断急性胰腺炎的正确率越大，但升高的幅度与病情严重程度不呈正相关（D对）。急性胰腺炎时血清淀粉酶在发病6～12小时开始增高（A错），12～72小时达到峰值（B错），超过正常值3倍有诊断价值（C错）。尿淀粉酶升高持续时间比血清淀粉酶长（E错），下降缓慢，1-2周后恢复正常。